具有温胃止呕，散寒止痛作用的灸法是
A. 隔姜灸
B. 隔蒜灸
C. 隔盐灸
D. 隔附子灸
E. 无瘢痕灸

正确答案：A。隔姜灸

解析：隔姜灸常用于因寒而致的呕吐、腹痛以及风寒痹痛等，有温胃止呕、散寒止痛的作用（A对）。隔蒜灸多用于治疗瘰疬、肺痨及初起的肿疡等病症，有清热解毒、杀虫等作用（B错）。隔盐灸多用于治疗伤寒阴证或吐泻并作、中风脱证等，有回阳，救逆，固脱之力（C错）。隔附子饼灸 多用于治疗命门火衰而致的阳痿、早泄或疮疡久溃不敛等，有温补肾阳等作用（D错）。无瘢痕灸一般虚寒性疾患均可采用此法多适用于虚寒症（E错）。